医患双方都具有独立人格要求医师做到
A. 不伤害患者
B. 从各方面关心患者
C. 患者是上帝
D. 平等待患
E. 关心患者心理需求

正确答案：D。平等待患

解析：本题考查医患关系伦理。医疗契约又称医疗合同，是指平等主体的患者与医疗机构之间设立、变更、终止民事权利与义务关系的协议。故医患关系中医师应该做到平等对待患者（D对）。